脓液不多且位于组织深部时，可采用的辨脓方法是
A. 按触法
B. 透光法
C. 切开法
D. 穿刺法
E. 点压法

正确答案：D。穿刺法

解析：按触法用两手指的指腹轻放于脓肿患部，相隔适当的距离，然后以一手指稍用力按一下，另一手指端即有一种波动的感觉，不适用于组织深部（A错）。透光法以患指（趾）遮住手电筒的光纤，然后注意观察患指（趾）部表面，若见其局部有深黑色的阴影即为有脓，适用于手指足趾（B错）。切开法是运用手术刀把脓肿切开，以使脓液排出，从而达到疮疡毒随脓泄、肿消痛止、逐渐向愈的目的，是疮疡的手术外治法（C错）。若脓液不多且位于组织深部时，用按触法辨脓有困难，可直接采用注射器穿刺抽脓方法（D对）。点压法在手指（趾）部，当病灶处脓液很少的情况下，可用点压法检查，简单易行，用大头针尾或火柴头等小的圆钝物，在患部轻轻点压，如测得有局限性的剧痛点，即为可疑脓肿（E错）。